最早口腔检查人员，是
A. 婴儿
B. 幼儿
C. 学龄儿童
D. 成人
E. 老年人

正确答案：A。婴儿

解析：本题考查婴幼儿口腔保健。最早口腔检查人员，是婴儿（A对）。儿童第一次口腔检查应在第一颗乳牙萌出后6个月内，或最迟在12个月之前。幼儿是指1～3岁（B错），2岁趋向于自己刷牙。学龄前儿童（C错）是指3～6岁的儿童，要注意避免牙外伤。成人及老年人（DE错）不是首次口腔检查的年龄。